新生儿，15天，生后母乳喂养每次哺乳后易溢乳，应采取的措施是
A. 哺乳后轻拍其背
B. 两次喂哺时间相隔3小时
C. 每次哺乳时间1小时
D. 减少每次哺乳量
E. 定时喂哺，每日6～8次

正确答案：A。哺乳后轻拍其背

解析：喂奶前应清洗乳头，奶后将婴儿竖立抱起、轻拍背部，以排出咽下的空气，防止溢奶（A对）。母乳喂养建议按需喂养（BCDE错）。